根据求医的决定权，可将求医行为分成
A. 主动型、参与型、强制型
B. 主动型、指导型、合作型
C. 主动型、被动型、强制型
D. 参与型、指导型、合作型
E. 参与型、被动型、强制型

正确答案：C。主动型、被动型、强制型